S₄产生机制是
A. 二尖瓣突然关闭
B. 三尖瓣突然关闭
C. 血流冲击心室壁
D. 心房收缩
E. 主动脉瓣突然关闭

正确答案：D。心房收缩

解析：S₄（第四心音）是心房肌在收缩末期为克服心室舒张末期压力而用力收缩所产生的震动，也称心房音（D对）。二尖瓣突然关闭（A错）、三尖瓣突然关闭（B错）产生第一心音。血流冲击心室壁（C错）产生第三心音。主动脉瓣突然关闭（E错）、肺动脉瓣突然关闭产生第二心音。